病灶在
A. 中脑
B. 右动眼神经
C. 右视束
D. 右侧外侧膝状体
E. 右视神经

正确答案：E。右视神经

解析：光照患者左眼, 双眼瞳孔缩小, 而光照右眼时, 双眼瞳孔均不缩小，可见患者左瞳孔对光反射通路正常，而右瞳孔对光反射通路异常，所以病灶应该在左右对光反射通路的不同处：右视神经（E对），之后的对光反射通路，左右相同，若有病变则左右对光反射均消失。